女，20岁。1个月前因工作差错被领导批评后出现心情烦躁，经常哭泣，认为自己没有能力，什么事都干不好，周围人的眼神不怀好意，看她笑话。失眠，早醒。近一周病情加重，觉得生不如死，在家中拒食等死。该患者最可能的诊断是
A. 广泛性焦虑障碍
B. 急性应激障碍
C. 分裂情感性精神障碍
D. 抑郁发作
E. 以上均不正确

正确答案：D。抑郁发作

解析：该患者1个月前出现心情烦躁、经常哭泣（心境低落），认为自己没有能力、什么事都干不好（自我评价降低），失眠、早醒（睡眠障碍），近一周病情加重，拒食等死（自杀行为），故最可能的诊断为抑郁发作（D对）。广泛性焦虑障碍（焦虑症）以焦虑为主要临床表现，患者常常有不明原因的提心吊胆、紧张不安，无情感低落（忧愁、苦闷、唉声叹气、暗自落泪，严重时可因悲观绝望而出现自杀企图及行为等）的表现，与本例不符（A错）。急性应激障碍的患者在急剧、严重的精神刺激下，立即表现有强烈恐惧体验的精神运动性兴奋（激越，喊叫，行为过多），行为具有一定的盲目性，或者为精神运动性抑制，甚至木僵，与本例不符（B错）。